男，10岁，发热皮肤黏膜出血2天就诊。四肢可见出血点，肝脾不大，查血常规：血红蛋白75g/L，白细胞，血小板明显降低，外周血见幼稚细胞0.02，Ret0.02，该患者可能出现下列哪项检查结果
A. 中性粒细胞增多
B. 中性粒细胞减少
C. 血涂片可见红细胞碎片
D. 晨起血红蛋白尿
E. 直接抗人球蛋白阳性

正确答案：B。中性粒细胞减少

解析：患者发热皮肤黏膜出血、肝脾不大（符合骨髓增生异常综合征的临床表现），血红蛋白、白细胞、血小板明显降低，网织红细胞0.02升高（正常值0.005～0.015），外周血可见幼稚细胞（符合骨髓增生异常综合征的血象特点），考虑骨髓增生异常综合征。骨髓增生异常综合征血细胞病态造血，血象中性粒细胞<1.8×10°/L（B对A错）。血涂片可见红细胞碎片（C错）是溶血性贫血的特点。晨起血红蛋白尿（D错）是阵发性睡眠性血红蛋白尿的特点。直接抗人球蛋白抗体阳性是（E错）是温抗体型溶血性贫血。